男，32岁。2天前饮酒后出现右上腹疼痛，向右肩部放射。查体：右上腹肌紧张，压痛（+），Murphy征（+）。最可能的诊断是
A. 十二指肠球部溃疡
B. 急性胃炎
C. 急性胆囊炎
D. 急性胰腺炎
E. 右肾结石

正确答案：C。急性胆囊炎

解析：中年患者，饮酒后出现右上腹疼痛，向右肩放射（急性胆囊炎典型临床表现），Murphy征阳性（急性胆囊炎典型体征）。根据患者临床表现及查体，最可能的诊断是急性胆囊炎（C对）。十二指肠球部溃疡（A错）多表现为长期上腹痛，多为饥饿痛，餐后缓解；急性胃炎（B错）的症状轻重不一，多表现为中上腹不适、疼痛，以及其他胃肠道非特异性症状；急性胰腺炎（D错）主要表现为左上腹痛并向左肩放射；右肾结石（E错）主要表现为背部肾区绞痛，以上疾病Murphy征均应为阴性。